男，56岁。乏力，食欲不振、恶心、消瘦1个月。乙型肝炎病史10年。查体：皮肤巩膜无黄染，腹软，剑突下压痛，肝肋下3cm，可触及质硬的结节，Murphy征阴性，移动性浊音阳性。为进一步查明肝脏结节的大小与位置，首选的检查是
A. PET-CT检查
B. MRI检查
C. 放射性核素扫描
D. B超检查
E. 肝动脉造影

正确答案：D。B超检查

解析：中老年患者，肝炎病史，消化道症状，肝大有质硬结节，考虑肝癌。B超（D对）对肝脏成像佳，可显示肿瘤位置、数目、大小、形态，操作简单、价格便宜、显示效果好，宜作为首选检查。PET-CT检查（A错）、放射性核素扫描（C错）属于核医学检查，价格极为昂贵，操作复杂，且图像分辨力差，不适宜检查肝脏结节大小与位置。MRI检查（B错）、肝动脉造影（E错）操作较为复杂，价格高，不适合作为首选检查。